甘油三酯合成的基本原料是
A. 甘油
B. 胆固醇酯
C. 胆碱
D. 鞘氨醇
E. 胆固醇

正确答案：A。甘油

解析：小肠黏膜细胞主要利用摄取的甘油三酯消化产物重新合成甘油三酯，当其以乳糜微粒形式运送至脂肪组织，肝等组织或器官后，脂肪酸亦可作为这些组织细胞合成甘油三酯的原料。脂肪组织还可水解极低密度脂蛋白甘油三酯，释放脂肪酸用于合成甘油三酯（A对）。这道题我们可以根据甘油三酯的化学式来记忆，将甘油三酯进行水解使其脂肪酸的位置换成氢，甘油三酯原来的骨架结构就变成了甘油，其水解下去的脂肪酸和改变的骨架结构甘油，构成了甘油三酯的合成原料。胆固醇酯是由脂肪酸和醇作用生成的酯，一般不溶于水而溶于脂溶性溶剂的化合物（B错）